烧伤休克的特点是
A. 低血容量性休克
B. 失血性休克
C. 脉搏增快
D. 尿量正常或减少
E. 血压正常或升高

正确答案：A。低血容量性休克

解析：烧伤休克绝大多数为继发性休克，通常发生在烧伤后最初数小时或十多个小时，属于低血容量性休克（A对），是由于受伤局部有大量血浆液自毛细血管渗出至创面和组织间隙，造成有效循环血量减少。